女性，30岁。继发不孕5年，经后4天突起高热寒战，下腹痛，右侧为甚，血压110/80mmHg，P120次/分，体温39℃，白细胞18×10⁹/L，中性粒细胞80%，下腹轻压痛，复查：宫颈稍大稍软，有压痛，双侧附件增厚，压痛，诊断为
A. 急性阑尾炎
B. 急性盆腔结缔组织炎
C. 急性盆腔腹膜炎
D. 急性子宫内膜炎
E. 以上均不是

正确答案：B。急性盆腔结缔组织炎

解析：患者为青年女性，出现高热寒战、右侧下腹痛（急性盆腔结缔组织炎的主要临床表现为寒战高热、下腹痛），妇检时发现患者宫颈增大、压痛、双侧附件增厚和压痛（妇检时可见宫颈充血、水肿，可扪及宫旁一侧或两侧片状增厚，或两侧宫底韧带高度水肿、增粗，压痛明显），最可能的诊断是急性盆腔结缔组织炎（B对）。急性阑尾炎（A错）的常见临床表现为转移性右下腹痛，发热，恶心呕吐，无双侧附件增厚、压痛。急性盆腔腹膜炎（P261）（C错）的主要临床表现为发热，下腹痛，阴道分泌物增多，出现腹膜炎刺激征（下腹压痛、反跳痛、肌紧张），大便里急后重。急性子宫内膜炎（P227）（E错）主要表现为由内膜坏死引起的阴道内大量脓性分泌物且有臭味，无双侧附件增厚。